由胃体部壁细胞分泌，且能破坏胃黏膜屏障作用造成消化性溃疡的是
A. 胃酸和胃蛋白酶
B. 非甾体抗炎药
C. 胃动力学异常
D. 幽门螺杆菌感染
E. 情绪紧张和焦虑

正确答案：A。胃酸和胃蛋白酶

解析：本题考查消化道溃疡的发病机制。胃酸和胃蛋白酶（A对）由胃体部壁细胞分泌，能破坏胃黏膜屏障造成消化性溃疡。非甾体类抗炎药（B错）通过抑制环氧合酶造成消化性溃疡。胃动力学异常（C错），如十二指肠内容物反流，其中胆盐、磷脂酶A和胰酶等破坏胃黏膜屏障，造成消化性溃疡。幽门螺杆菌感染（D错）、情绪紧张和焦虑（E错）均会造成消化性溃疡，但是不是胃体部壁细胞分泌。